与草乌不相反的药是
A. 赤芍
B. 川贝母
C. 天花粉
D. 全瓜蒌
E. 半夏

正确答案：A。赤芍

解析：本题考查十八反的主要内容。与草乌不相反的药是赤芍（A对）。十八反列述了三组相反药，分别是：甘草反甘遂、京大戟、海藻、芫花；乌头（川乌、附子、草乌）反半夏（E错）、瓜蒌（全瓜蒌（D错）、瓜蒌皮、瓜蒌仁、天花粉（C错））、贝母（B错）（川贝、浙贝）、白蔹、白及；藜芦反人参、南沙参、丹参、玄参、苦参、细辛、芍药（赤芍、白芍）。